有机磷农药中毒时，皮肤污染部位的清洗要用
A. 热水
B. 温水
C. 冷水
D. 肥皂水
E. 70%酒精

正确答案：D。肥皂水

解析：本题考查有机磷农药中毒的处理。当发生急性有机磷农药中毒时，应首先清除毒物，立即使病人脱离中毒现场，脱去污染衣服，用肥皂水（D对ABCE错）（忌用热水）彻底清洗污染的皮肤、头发、指甲；眼部如受污染，应迅速用清水或2%碳酸氢钠溶液冲洗。然后迅速给予特效解毒药进行治疗，最后采取对症治疗的方法。